新鲜空气中，重轻离子比值（N/n）应是
A. ≤1.0
B. ≥1.0
C. ＜50
D. ＞50
E. ≥1.2

正确答案：C。＜50

解析：本题考查新鲜空气中，重轻离子比值。重轻离子比值（N/n）是指空气中重离子（N）与轻离子（n）的比值，它是空气中离子的重要特征之一，可以反映空气中离子的组成和结构。一般来说，新鲜空气中，重轻离子比值（N/n）应小于50（C对ABDE错）。